水被有机物污染后，在有氧气的条件下，经微生物作用，分解成二氧化碳、水、硝酸盐、硫酸盐等。这种自净作用称为
A. 分解作用
B. 转化作用
C. 氧化还原作用
D. 生物降解作用
E. 腐殖化作用

正确答案：D。生物降解作用

解析：本题考查生物降解作用。生物降解作用（D对ABCE错）是指当水被有机物污染后，在有氧条件下，微生物利用这些有机物作为营养物质，经过生物活动，将有机物分解成二氧化碳、水、硝酸盐和硫酸盐等无机物质的过程。